流行性出血热的脑水肿多发生在哪期
A. 发热期
B. 少尿期
C. 低血压休克期
D. 多尿期
E. 恢复期

正确答案：C。低血压休克期

解析：流行性出血热在低血压休克期（C对）由于长期组织灌注不良，可出现脑水肿、DIC等；发热期（A错）主要表现为发热、中毒症状、全身毛细血管损伤和肾脏损害；少尿期（B错）表现为厌食、恶心、呕吐、腹胀和腹泻等；多尿期（D错）主要为多尿，后期临床症状和体征逐步消退；恢复期（E错）随着尿液稀释与浓缩功能逐渐恢复正常，少数患者可遗留高血压、肾功能障碍、心肌劳损和垂体功能减退等症状。